下列刺激中哪项不易引起内脏痛
A. 切割
B. 牵拉
C. 缺血
D. 痉挛
E. 炎症

正确答案：A。切割